肝性脑病的诱因不包括
A. 消化道出血
B. 高钾性酸中毒
C. 便秘
D. 低血糖
E. 缺氧

正确答案：B。高钾性酸中毒

解析：氨是肝性脑病最主要的神经毒素，消化道是产氨的主要部位。游离的NH₃有毒性，且能透过血脑屏障，而离子型氨（NH₄⁺）无毒性，不易透过血脑屏障。NH₃和NH₄⁺在体内可受pH梯度的影响而相互转化（NH₃+H⁺⇌NH₄⁺）：NH₃在酸性环境中，可与H⁺结合形成NH₄⁺，随粪便排出体外；在碱性环境中，NH₄⁺ 解离为NH₃和H⁺，NH₃大量弥散入血，导致肝性脑病。高钾性酸中毒（B错，为本题正确答案）时，NH₃转为NH₄⁺，可降低血NH₃的浓度，减轻肝性脑病。消化道出血（A对）时，肠道细菌对含氮物质（100ml血液约含20g蛋白质）的分解增加，产氨增多，诱发肝性脑病。便秘（C对）时含氮物质与肠道细菌接触时间延长，有利于氨的产生和吸收。低血糖（D对）时葡萄糖的氧化磷酸化减少，不利于NH₃与谷氨酸的结合，使游离NH₃的浓度增加，诱发肝性脑病。缺氧（E对）可导致肾性氮质血症，使血氨增高；且脑细胞缺氧可降低脑对氨毒的耐受性，都会诱发肝性脑病。